某女，16岁。春三月突患热病，症见发热、微恶风寒、咳嗽、痰黄、头痛、口渴，舌红苔黄。证属风温肺热、卫气同病，宜选用的中成药是
A. 葛根岑连丸
B. 荆防颗粒
C. 双清口服液
D. 连花清瘟胶囊
E. 九味羌活口服液

正确答案：C。双清口服液

解析：本题考查的是双清口服液的主治。突患热病，症见发热、微恶风寒、咳嗽、痰黄、头痛、口渴，舌红苔黄。证属风温肺热、卫气同病，宜选用的中成药是双清口服液（C对）。双清口服液：【主治】风温肺热，卫气同病，症见发热、微恶风寒、咳嗽、痰黄、头痛、口渴、舌红苔黄或黄白苔相兼，脉浮滑或浮数；急性支气管炎见上述证候者。葛根芩连丸（A错）：【主治】湿热蕴结所致的泄泻腹痛、便黄而黏、肛门灼热；以及风热感冒所致的发热恶风、头痛身痛。荆防颗粒（B错）：【主治】外感风寒挟湿所致的感冒，症见头身疼痛、恶寒无汗、鼻塞流涕、咳嗽。连花清瘟胶囊（D错）：【主治】流行性感冒属热毒袭肺证，症见发热、恶寒、肌肉酸痛、鼻塞流涕、咳嗽、头痛、咽干咽痛、舌偏红、苔黄或黄腻。九味羌活口服液（E错）：【主治】外感风寒夹湿所致的感冒，症见恶寒、发热、无汗、头重而痛、肢体酸痛。